我国工业企业噪声卫生标准采用
A. 总声级
B. A声级
C. B声级
D. C声级
E. D声级

正确答案：B。A声级